危险交流的主要信息包括
A. 危险的性质
B. 危险性管理的措施
C. 危险分析过程的全面有效性
D. A和B
E. A和C

正确答案：D。A和B